社区健康教育的重点在于
A. 个体健康
B. 加强家庭健康教育
C. 个体与群体的结合
D. 重点解决危险因素
E. 重点是解决环境问题

正确答案：B。加强家庭健康教育